具有高级专业技术职务任职资格的医师，可授予
A. 一级使用级抗菌药物处方权
B. 备用使用级抗菌药物处方权
C. 特殊使用级抗菌药物处方权
D. 限制使用级抗菌药物处方权
E. 非限制使用级抗菌药物处方权

正确答案：C。特殊使用级抗菌药物处方权

解析：《抗菌药物临床应用管理办法》规定，具有高级专业技术职务任职资格的医师，可授予特殊使用级抗菌药物处方权。掌握“抗菌药物临床应用、监督及法律责任”知识点。